以下关于磨牙应用解剖的说法正确的是
A. 上下颌第一磨牙早期龋坏可以拔除，不用及时修复
B. 混合牙列期拔牙时应注意鉴别第一磨牙与第一乳磨牙形态，以免误认
C. 上颌磨牙断根在取出时容易将断根推入相邻颌面间隙中
D. 下颌第三磨牙断根拔除时容易将断根推入下颌管
E. 上颌第三磨牙是寻找腮腺导管口的标志，拔除时还要注意牙根数目、方向

正确答案：D。下颌第三磨牙断根拔除时容易将断根推入下颌管

解析：本题考查磨牙的应用解剖。下颌第三磨牙断根拔除时容易将断根推入下颌管（D对）。下颌磨牙根尖与下颌神经管接近，断根拔除时易推入下颌管，不宜使用压力。上、下颌第一磨牙早期龋坏应及时修复，尽量保留，不可轻易拔除（A错），它们的位置关系在建立正常咬合过程中起重要作用。混合牙列期拔牙时应注意鉴别第一磨牙与第二乳磨牙（B错），两者形态相似，位置邻近，容易误认。上颌磨牙断根拔除时易进入上颌窦（C错），不应使用推力。上颌第三磨牙是寻找腭大孔的标志，上颌第二磨牙牙冠颊面正对的颊黏膜为腮腺管口的开口处（E错）。拔除上、下颌磨牙时，应注意牙根的数目、分叉度和方向。